《痹论》心痹的证候应除外哪一项
A. 时发飧泄
B. 厥气上则恐
C. 脉不通，烦则心下鼓
D. 暴上气而喘
E. 嗌肝善噫

正确答案：A。时发飧泄

解析：肠痹者，数饮而出不得，中气喘争，时发飧泄（A错，为本题正确答案）。心痹者，脉不通，烦则心下鼓（C对），暴上气而喘（D对）。嗌干善噫（E对），厥气上则恐（B对）。